饮留胃肠证的临床表现是
A. 全身皆肿，按之凹陷，小便不利，苔润，脉濡缓
B. 咳嗽气喘，痰多色白质稀，胸闷心悸，喉中哮鸣
C. 咳嗽咯痰，痰质黏稠，脘痞纳呆，呕吐痰涎
D. 咳嗽，胸胁饱满，支撑胀痛，随呼吸咳嗽转侧而痛
E. 脘腹痞胀，水声辘辘，泛吐稀涎或清水，舌淡苔白滑，脉弦

正确答案：E。脘腹痞胀，水声辘辘，泛吐稀涎或清水，舌淡苔白滑，脉弦

解析：停留胃肠表现为脘腹痞胀，泛吐清水，脘腹部水声辘辘（E对）。水停证表现为头面、肢体，甚或全身浮肿，按之凹陷不起，或为腹水而见腹部膨隆、叩之音浊，小便短少不利，周身困重，舌淡胖，苔白滑，脉濡或缓（A错）。饮停心肺表现为胸闷，心悸，息促不得卧；饮邪犯肺表现为胸部紧闷，咳吐清稀痰涎，或喉间哮鸣有声（B错）。痰证表现为咳嗽痰多，痰质黏稠，胸院疮闷，恶心纳呆，呕吐痰涎，头晕目眩，形体肥胖（C错）。饮停胸胁，阻碍气机，则肋间饱满，咳唾引痛，胸闷息促（D错）。